女，41岁。上腹胀痛10余年。常伴烧心，多在餐后约1小时发作，约1～2小时可自行缓解。秋冬及冬春季症状明显。胃镜下黏膜活检组织Worthin-Starry银染色阳性，提示细菌感染。这种致病菌的特点不包括
A. 尿素酶试验阳性
B. 至少需质子泵抑制剂加两种抗生素治疗
C. 培养时需要加入5%～10%羊血或马血
D. 革兰染色阳性
E. 培养3～7日可见针尖大小的菌落

正确答案：D。革兰染色阳性

解析：中年女性患者，上腹胀痛10余年（慢性过程），常伴烧心，且多在餐后约1小时发作（餐后痛），秋冬及冬春季症状明显（周期性发作），考虑诊断为胃溃疡。胃镜下黏膜活检组织Worthin-Starty银染色阳性，提示该患者有幽门螺杆菌感染。幽门螺杆菌革兰染色阴性（八版医学微生物学P129）（D错，为本题正确答案），该菌可产生尿素酶，尿素酶试验阳性（A对）。幽门螺杆菌感染治疗方法为三联疗法：1种质子泵抑制剂或1种铋剂+2种抗生素（B对），疗程7～14天，但九版内科学根除疗法改为了含有铋剂的四联方案（B错）。幽门螺杆菌的生长营养要求高，培养时需加入动物血清或血液，如5％～10％羊血或马血（C对），培养3～7日可见针尖大小的菌落（八版医学微生物学P130）（E对）。